20世纪20年代初，在印度发现狼孩，7～8岁时被人发现时已没有语言能力，不能独立行走，尽管专家提供了优厚的生活条件和学习条件，但直至6年后其才开始行走，这与训练动物的时间不相上下，到17岁死去之前，仅学会几十个单词，整体发育相当于2岁儿童水平，通过此例子，你认为下面哪个答案是正确的
A. 狼孩的遗传基因没有缺陷，但营养太差
B. 狼孩的智力有问题，学习有困难
C. 狼孩的遗传基因有缺陷，接受能力差
D. 狼孩的遗传基因没有缺陷，但已错过接受教育的关键期
E. 狼孩受恶劣环境影响，造成智力下降

正确答案：D。狼孩的遗传基因没有缺陷，但已错过接受教育的关键期